正常小儿1岁时的体重、身长、头围分别是
A. 6kg、70cm、40cm
B. 10kg、75cm、46cm
C. 12kg、80cm、48cm
D. 9kg、85cm、48cm
E. 9kg、80cm、50cm

正确答案：B。10kg、75cm、46cm

解析：1岁时体重约10kg，一般1岁时身长达75cm，1岁时头围达46cm。掌握“体格生长常用指标”知识点。